病原菌在局部繁殖，毒素入血称为
A. 败血症
B. 毒血症
C. 内毒素血症
D. 脓毒血症
E. 菌血症

正确答案：B。毒血症